初孕妇，26岁。妊娠38周，自觉胎动减少10小时入院。应立即釆取的措施不包括
A. 胎儿电子监护
B. 间歇吸氧
C. 左侧卧位
D. 胎儿生物物理评分
E. 立即终止妊娠

正确答案：E。立即终止妊娠

解析：青年初孕妇，妊娠38周（慢性胎儿窘迫多发生在妊娠晚期），自觉胎动减少（慢性胎儿窘迫会出现胎动减少或消失），该孕妇可考虑为慢性胎儿窘迫，应立刻行胎儿电子监护（A对）和进行胎儿生物物理评分（D对），观察是否提示胎儿存在缺氧，若存在胎儿缺氧应该立即采取相应措施纠正胎儿缺氧，包括孕妇左侧卧位（C对）、给孕妇间歇吸氧（B对）、停止缩宫素使用、抑制宫缩、纠正孕妇低血压等措施，如果这些措施均不奏效，或窘迫加重时，应该紧急终止妊娠（E错，为本题正确答案）。